顽固性高血压最常见于
A. 高龄
B. 遗传
C. 病程长
D. 体位性
E. 未规律服药

正确答案：A。高龄

解析：尽管使用了包括利尿剂在内的三种以上合适剂量降压药联合治疗后，血压仍未能达到目标水平，或者使用四种或四种以上降压药物，血压达标也称为顽固性高血压，多见于广泛动脉粥样硬化和钙化的老年人（A对BCDE错）。